PHC是指
A. 扩大计划免疫
B. 初级卫生保健
C. 全球卫生策略
D. 人人享有卫生保健

正确答案：B。初级卫生保健

解析：本题考查PHC。PHC是指初级卫生保健（B对ACD错）。初级卫生保健是指最基本的、人人都能得到的、体现社会平等权利的、人民群众和政府都能负担得起的卫生保健服务。